可用于提高老年人用药依从性的措施有
A. 选择简化的用药方案
B. 使用分时药盒
C. 优先选用注射剂
D. 进行用药指导
E. 告知家属帮助督导

正确答案：A、B、D、E。选择简化的用药方案；使用分时药盒；进行用药指导；告知家属帮助督导

解析：本题考查提高患者依从性的方法。提高患者依从性的方法包括：（1）用药方案尽量简化（A对），使用半衰期较长的药物或缓、控释制剂，每日1次给药。（2）针对不同患者人群，可选择符合不同人群生理及心理特点的药物（C错）。（3）要用通俗、简洁的言语向患者说明各个药物的用法用量、注意事项，以及可能产生的不良反应（D对）。（4）使患者了解药物的重要性，对于效果不易察觉或起效慢的药物，应特别提示患者，告知应坚持服药。（5）告知患者如何鉴别哪些是严重不良反应，若发生不良反应，应采取哪些措施。（6）对于记忆力差的老年患者可使用分时药盒（B对），或建议家属、照料者监督其服药（E对），增强用药依从性。